国家二级保护野生药材物种为
A. 资源严重减少的主要常用野生药材物种
B. 资源处于衰竭状态的名贵野生药材物种
C. 濒临灭绝状态的稀有珍贵野生药材物种
D. 资源严重减少的重要野生药材物种
E. 分布区域缩小、资源处于衰竭状态的重要野生药材物种

正确答案：E。分布区域缩小、资源处于衰竭状态的重要野生药材物种

解析：本题考查二级保护野生药材物种。国家重点保护的野生药材物种分为三级管理。一级保护野生药材物种系指濒临灭绝状态的稀有珍贵野生药材物种（C错）。二级保护野生药材物种系指分布区域缩小、资源处于衰竭状态的重要野生药材物种（E对）。三级保护野生药材物种系指资源严重减少的主要常用野生药材物种（A错）。